被称为“孤府”的是
A. 胃
B. 小肠
C. 大肠
D. 膀胱
E. 三焦

正确答案：E。三焦

解析：三焦纵贯躯干，无脏与之匹配故称孤府。《灵枢·本输》说：“三焦者，中渎之府也，水道出焉，属膀胱，是孤之府也”（E对）。胃（A错）为“太仓”，“水谷之海”，“仓廪之官”；小肠（B错）为“受盛之官”；大肠（C错）为“传导之官”；膀胱（D错）为“州都之官”。